属于胆固醇吸收抑制剂，适用于原发性高胆固醇血症、纯合子家族性高胆固醇血症、纯合子谷甾醇血症的药物是
A. 阿托伐他汀
B. 依折麦布
C. 普罗布考
D. 考来烯胺
E. 非诺贝特

正确答案：B。依折麦布

解析：本题考查胆固醇吸收抑制剂。依折麦布（B对）为胆固醇吸收抑制剂。